在设计的范围内，测试结果与试样中被测物浓度直接呈正比关系的程度称为
A. 精密度
B. 耐用性
C. 准确度
D. 线性
E. 范围

正确答案：D。线性